某地某年8月发生了一起由食用蛋、奶糖制作的雪糕而引起的食物中毒，症状为腹痛，腹泻。大便如水样黏液便，少数病人有浓血便，部分病人体温为38～39℃，多数人潜伏期为12～24小时，你认为最可能是哪种食物中毒
A. 葡萄球菌肠毒素中毒
B. 副溶血性弧菌食物中毒
C. 变形杆菌食物中毒
D. 沙门菌属食物中毒
E. 肉毒毒素中毒

正确答案：D。沙门菌属食物中毒

解析：沙门菌食物中毒：由食用沙门菌污染食品所致，其流行病学特点是：①季节：全年皆可发生，多见于夏秋季，5～10月发病数可达全年发病总数的80%；②食品种类：引起沙门菌食物中毒的食品主要为动物性食品，特别是畜肉类及其制品，其次为禽肉、蛋类、乳类，由植物性食物引起者很少。临床表现的特点为腹泻一日可数次至十余次，主要为水样便，少数带有黏液或血。掌握“食品安全”知识点。